男，40岁。半日来腹泻20多次，稀水样便，无明显发热及腹痛。查体：T36°C，P100次／分，R20次／分，BP90/60mmHg，神智清，轻度脱水，腹软无压痛，肠鸣音活跃。粪便常规检白细胞0-1/HP。最可能的诊断是
A. 急性肠炎
B. 阿米巴痢疾
C. 胃肠型食物中毒
D. 霍乱
E. 急性细菌性痢疾

正确答案：D。霍乱

解析：男性患者40岁，半日来腹泻20多次，稀水样便，无明显发热及腹痛，为霍乱泄吐期的典型表现，霍乱患者粪便常规可见少许白细胞，该患者粪检白细胞0～1/HP，也符合霍乱的实验室检查，所以最可能的诊断是霍乱（D对）。急性肠炎常有明确诱因，可有腹痛、腹泻及全身症状等（A错）。阿米巴痢疾是由溶组织内阿米巴寄生于结肠引起的疾病，主要病变部位在近端结肠和盲肠，典型的临床表现有果酱样粪便等痢疾样症状（B错）。胃肠型食物中毒与食入污染食物有明显关系（C错）。急性细菌性痢疾主要表现为腹痛、腹泻、排黏液脓血便以及里急后重等，可伴有发热及全身毒血症状，严重者可出现感染性休克和（或）中毒性脑病（E错）。